影响结构非特异性全身麻醉药活性的因素是
A. 解离度
B. 分配系数
C. 立体构型
D. 空间构象
E. 电子云密度分布

正确答案：B。分配系数

解析：本题考查药物的分配系数对药效的影响。影响结构非特异性全身麻醉药活性的因素是分配系数（B对）。对于结构非特异性药物，药物的理化性质直接影响药物的活性。药物的理化性质主要有药物的溶解度、分配系数和解离度。通常药物以非解离的形式被吸收，进入细胞后，在膜内的水介质中解离成解离形式起作用，故解离度（A错）不是影响手性药物对映体之间活性差异的因素。影响手性药物对映体之间活性差异的因素是立体构型（C错）。空间构象（D错）是指分子中原子或基团在三维空间的取向和定位。电子云密度（E错）能决定原子的成键方向和成键强度。